男性，17岁。上前牙牙面有白色斑块合并缺损求治。10岁前一直住在东北地区。口腔检查：上颌321|123釉质严重发育不全，牙表面有带状和窝状的棕色凹陷，叩诊（-），无松动。最可能的诊断是
A. 釉质发育不全
B. 氟牙症
C. 四环素牙
D. 遗传性牙本质发育不全
E. 先天性梅毒牙

正确答案：B。氟牙症

解析：本题考查氟牙症。男性，17岁。上前牙牙面有白色斑块合并缺损求治。10岁前一直住在东北地区。口腔检查：上颌321123釉质严重发育不全，牙表面有带状和窝状的棕色凹陷，叩诊（-），无松动。最可能的诊断是氟牙症（B对）。患者上前牙牙面有白色斑块合并缺损，10岁前一直住在东北地区，有高氟区生活史（符合6、7岁前生活在高氟区），患者最可能患的是氟牙症。釉质发育不全是指在牙发育期间，由于全身疾患、营养障碍或严重的乳牙根尖周感染导致的釉质结构异常，东北地区为高氟区，而釉质发育不全无高氟区生活史（A错）。四环素牙初呈黄色，以后逐渐由黄色变成棕褐色或深灰色（C错）。遗传性乳光牙本质，牙冠呈微黄色，半透明，光照下呈现乳光（D错）。先天性梅毒牙可表现为半月形切牙、桑葚状磨牙及蕾状磨牙（E错）。